用砂炒的是
A. 斑蝥
B. 决明子
C. 白术
D. 马钱子
E. 水蛭

正确答案：D。马钱子

解析：本题考查的是适合砂炒的药材。用砂炒的是马钱子（D对）。马钱子：【炮制方法】处方用名有马钱子、制马钱子。①马钱子：取原药材，除去杂质，筛去灰屑。②制马钱子：a.砂烫：将砂置炒制容器内，用文火加热至滑利状态，容易翻动时，投入大小一致的马钱子，不断翻动，炒至棕褐色或深棕色，鼓起，内部红褐色，并起小泡时，取出，筛去砂子，放凉。亦可供制马钱子粉用。b.油炸：取麻油适量置锅内，加热至230℃左右，投入马钱子，炸至老黄色时，立即取出，沥去油，放凉。用时碾粉。③马钱子粉：取制马钱子，粉碎成细粉，测定士的宁的含量后，加适量淀粉，使含量符合规定，混匀，即得。斑蝥（A错）：【炮制方法】处方用名有斑蝥、炒斑蝥、米炒斑蝥。①斑蝥：取原药材，除去杂质，或取原药材，除去头、足、翅及杂质。②米炒斑蝥：将米置热锅中，用中文火加热至冒烟，投入斑蝥拌炒，至米呈黄棕色，取出，筛去米，除去头、足、翅，摊开放凉。或者投入去头、足、翅的斑蝥拌炒，至米呈黄棕色，取出，筛去米，摊开放凉。每100kg斑蝥，用米20kg。注意事项：斑蝥在炮制和研粉加工时，操作人员宜戴眼罩或防毒面具进行操作，以保护眼、鼻黏膜免受其损伤，炒制后的米要妥善处理，以免伤害人畜，发生意外事故。白术（C错）：【炮制方法】处方用名有白术、土炒白术、麸炒白术。①白术：取原药材，除去杂质，用水洗净，润透，切厚片，干燥，筛去碎屑。②土炒白术：先将土置锅内，用中火加热，炒至土呈灵活状态时，投入白术片，炒至白术表面均匀挂上土粉时，取出，筛去土粉，放凉。每100kg白术片，用灶心土25kg。③麸炒白术：先将锅用中火烧热，撒入麦麸（或蜜炙麦麸），待冒烟时，投入白术片，不断翻炒，至白术呈焦黄色，逸出焦香气，取出，筛去麦麸，放凉。每100kg白术片，用麦麸10kg。水蛭（E错）的：【炮制方法】处方用名有水蛭、制水蛭、炒水蛭。①水蛭：取水蛭，洗净，闷软，切断，晒干。②烫水蛭：取滑石粉置锅内，中火加热至灵活状态时，投入水蛭段，勤加翻动，拌炒至微鼓起，呈黄棕色时取出，筛去滑石粉，放凉。每100kg水蛭，用滑石粉40kg。决明子（B错）的炮制方法，2022年考试指南未明确说明。